剧烈运动时尿量减少的主要原因是
A. 体循环动脉压下降
B. 醛固酮分泌增多
C. 肾血流量减少
D. 血浆胶体渗透压升高
E. 肾小管对水重吸收增加

正确答案：C。肾血流量减少